第二类精神药品处方留存
A. 1年
B. 2年
C. 3年
D. 4年
E. 5年

正确答案：B。2年

解析：本题考查第二类精神药品处方保存期限。第二类精神药品处方留存2年（B对）。医疗机构应当对麻醉药品和精神药品处方进行专册登记，加强管理。麻醉药品处方至少保存3年，精神药品处方至少保存2年。